要想获得临床精确的牙周袋深度或附着水平，应掌握的探诊要点是
A. 使用标准化的探针
B. 掌握正确的探诊力量
C. 平行于牙长轴的探诊方向
D. 按顺序提插式行走的探诊过程和稳固的支点
E. 以上均是

正确答案：E。以上均是

解析：本题考查牙周探诊。要想获得临床精确的牙周袋深度或附着水平，应掌握的探诊要点有：牙周探诊在临床上是用标准化的探针（A对）来进行探测，工作端基本为圆柱形，逐渐变细，利于插入，尖端处为钝头，直径为0.5mm。探诊时掌握正确的探诊力量（B对），探诊力度不可过大，一般掌握在20～25g的探诊压力为好，要做到既探测到实际深度又不致使患者疼痛和损伤牙龈。在测量牙周袋时，牙周探针尖始终紧贴牙面，保持平行于牙长轴的探诊方向（C对），可较准确地探测出牙周袋深度。在探诊过程中应沿着牙周袋底提插式行走，以便探明同一牙面上不同深度的牙周袋；在探诊时，支点要放稳（D对），用力不可过大，否则探针会插入袋底深部使牙周袋深度偏大且会损伤牙龈。（ABCD均对，故E为本题的正确答案）。